舌短缩色青紫而湿润者多属
A. 痰湿内阻
B. 寒凝筋脉
C. 热盛津伤
D. 脾虚不运
E. 肝风内动

正确答案：B。寒凝筋脉

解析：短缩舌为舌体卷短、紧缩，不能伸长，甚至伸舌难于抵齿，主寒凝、痰阻、血虚和津伤。舌短缩色青紫而湿润者多属寒凝筋脉（B对）。舌短缩而胖，苔滑腻者，多因脾虚不运，痰湿内阻（AD错）。热盛津伤可见于舌短缩而红绛干燥者（C错）。颤动舌多主肝风内动（E错）。